嗜中温菌的最适产毒繁殖温度是
A. 10～50℃
B. 10～40℃
C. 10～30℃
D. 20～40℃
E. 20～50℃

正确答案：D。20～40℃